衡量机体维生素B₂营养状况，最常用的实验室检查方法是
A. 红细胞内转酮醇酶活性测定
B. 白细胞内维生素B2含量
C. 尿负荷试验
D. 暗适应测定
E. 红细胞NAD含量

正确答案：C。尿负荷试验